一般情况下KennedyⅢ类义齿功能好的主要原因是
A. 缺牙数目少
B. 义齿采用双侧设计
C. 缺隙的两侧都有基牙
D. 为黏膜支持式义齿
E. 为混合支持式义齿

正确答案：C。缺隙的两侧都有基牙

解析：此类义齿的（牙合）力主要是由基牙负担，若缺隙的近中或远中邻牙不宜放置（牙合）支托时，可设计成混合支持式义齿。KennedyⅢ类义齿特点，缺隙两端均有余留牙存在，无游离鞍基，故基牙不受扭力。义齿固位稳定和支持作用均好，压痛少。是各类牙列缺损中修复效果最好的一类。掌握“局部义齿的设计”知识点。